某病人慢性左中耳炎5年，近来因感冒加重，发烧并头痛，医生检查见耳后乳突明显压痛，局部皮肤水肿，其他无异常，考虑原因为
A. 中耳炎致咽鼓管感染
B. 中耳炎引起脑膜炎
C. 中耳炎引起内耳炎症
D. 中耳炎通过乳突窦引起乳突炎
E. 中耳炎伴有外耳道皮肤疖肿

正确答案：D。中耳炎通过乳突窦引起乳突炎

解析：检查见耳后乳突明显压痛，局部皮肤水肿，其他无异常，可推测乳突炎，慢性左中耳炎5年，可考虑长期炎症导致后壁损伤侵入乳突小房（D对）。